能够促进或阻碍疾病发生的因素称为
A. 疾病的原因
B. 疾病的诱因
C. 疾病的条件
D. 疾病的外因
E. 疾病的危险因素

正确答案：C。疾病的条件

解析：疾病发生的条件（C对）是指能促进或减缓疾病发生的某种机体状态或自然环境或社会因素。能够引起疾病并决定疾病特异性的致病因素称为疾病的原因（A错）；诱因指能加强病因的作用而促进疾病发生发展的因素，所以能够促进疾病发生的因素称为诱因（B错）；可以引起疾病的外部条件称为疾病的外因（D错）；可以促进特定疾病发生发展的因素称为疾病的危险因素（E错）。